海绵窦叙述错误的是
A. 位于蝶鞍两侧
B. 左、右侧海绵窦相交通
C. 面部感染可蔓延至此处
D. 血液可直接注入颈内静脉
E. 向后与基底静脉丛相交通

正确答案：D。血液可直接注入颈内静脉

解析：海绵窦位于蝶鞍两侧（A对），两侧海绵窦借横支相连（B对），海绵窦与周围的静脉有广泛的交通和联系，其前方接受眼静脉，两侧接受大脑中浅静脉，向后外经岩上窦和岩下窦连通横窦、乙状窦或颈内静脉（D错，为本题的正确答案）等，故面部感染可经这些交通蔓延至海绵窦（C对）。